腹膜炎典型的三联征是
A. 腹痛，腹泻，腹肌紧张
B. 压痛，反跳痛，腹肌紧张
C. 腹痛，腹泻，压痛
D. 压痛，反跳痛，腹部包块
E. 腹痛，腹泻，腹部包块

正确答案：B。压痛，反跳痛，腹肌紧张

解析：腹膜炎典型的三联征是腹部压痛、反跳痛和腹肌紧张（B对），又称腹膜刺激征，是腹膜炎的标志性体征。腹膜炎一般不会出现腹泻、腹部包块等表现（ACDE错）。